患者急性阑尾炎手术，血化验示抗HIV(+),医生术后发现其手上有伤口，请问医生应给予该患者的处理是
A. 抗生素治疗
B. 免疫球蛋白治疗
C. 抗病毒药治疗
D. 输液
E. 观察

正确答案：C。抗病毒药治疗

解析：患者急性阑尾炎手术，医生术后发现患者手上有伤口，患者血化验示抗HIV(+),结合患者出现的症状，应给予抗病毒药治疗（C对）。抗生素治疗（A错）对HIV病毒无抑制作用。免疫球蛋白（B错）只能提高自身免疫力。